下列有关地西泮的应用，错误的是
A. 焦虑症
B. 持续睡眠障碍
C. 癫痫小发作
D. 中枢性肌痉挛
E. 破伤风

正确答案：C。癫痫小发作

解析：地西泮临床应用：①焦虑症（A对）②失眠症：睡眠持续障碍者（B对）③麻醉前给药④惊厥和癫痫：用于小儿高热、破伤风（E对）、子痫和药物中毒所致惊厥的辅助治疗。地西泮起效快，安全性大，常静脉注射用于癫痫大发作的持续状态（C错，为本题正确答案）。⑤缓解肌紧张：中枢神经系统疾病引起的肌张力增强、局部病变如腰肌劳损及内窥镜检查所致的肌肉痉挛有缓解作用（D对），且不影响协调性。